对于M细胞描述错误的是
A. 呈穹隆状
B. 可摄取肠腔内抗原性异物
C. 可转运抗原
D. 是专职APC细胞
E. 包绕着T细胞、B细胞、Mφ和DC

正确答案：D。是专职APC细胞